能清热息风的药是
A. 蒺藜
B. 地龙
C. 蜈蚣
D. 石决明
E. 青黛

正确答案：B。地龙

解析：本题考查的是地龙的功效。能清热息风的药是地龙（B对）。地龙：【功效】清热息风，平喘，通络，利尿。蒺藜（A错）：【功效】平肝，疏肝，祛风明目，散风止痒。蜈蚣（C错）：【功效】息风止痉，攻毒散结，通络止痛。石决明（D错）：【功效】平肝潜阳，清肝明目。青黛（E错）：【功效】清热解毒，凉血消斑，定惊。